具有清除衰老细胞功能的是
A. 免疫自稳
B. 免疫传输
C. 免疫监视
D. 免疫阻抗
E. 免疫防御

正确答案：A。免疫自稳

解析：免疫自稳是免疫系统清除损伤或衰老细胞的功能。免疫自稳功能失调的个体易患自身免疫性疾病。掌握“基本概念”知识点。